骨肉瘤的影像学表现
A. 日光放射状
B. 膜新骨形成，典型者呈葱皮样改变，邻近髓质骨常有硬化
C. 呈斑点状、虫蚀状、网格状
D. 骨密度减低区，边界模糊不清
E. 高密度，点状或小片状钙化影

正确答案：A。日光放射状

解析：本题考查颌骨恶性肿瘤的影像特点。骨肉瘤的影像学表现为日光放射状（A对）。X线和CBCT上，骨肉瘤表现类型有3种：①低密度X线透射改变；②高密度X线阻射改变；③混合密度改变。病变内的高密度改变多为肿瘤骨所致，可呈日光状、针状、颗粒状、棉絮状、蜂窝状和束状。膜新骨形成，典型者呈葱皮样改变，邻近髓质骨常有硬化（B错）为Garre骨髓炎的影像学表现。呈斑点状、虫蚀状、网格状（C错）为放射性颌骨骨髓炎的影像学表现。骨密度减低区，边界模糊不清（D错）为牙源性中央性颌骨骨髓炎的影像学表现。高密度，点状或小片状钙化影为（E错）牙骨质不良结构的影像学表现。